男性患者，75岁，突然晕厥。查体：神志淡漠，血压85/65mmHg，心率38次/分，四肢湿冷；心电图示急性下壁心肌梗死，Ⅲ度房室传导阻滞。首选的治疗措施是
A. 安装临时心脏起搏器
B. 安装永久性心脏起搏器
C. 肾上腺皮质激素
D. 异丙肾上腺素静脉滴注
E. 阿托品静脉滴注

正确答案：A。安装临时心脏起搏器

解析：患者晕厥后查体并做心电图显示急性下壁心肌梗死，Ⅲ度房室传导阻滞，首选治疗措施是安装临时心脏起搏器（A对）。安装永久性心脏起搏器用于严重缓慢性心律失常（B错）。肾上腺皮质激素用于急、慢性肾上腺皮质功能减退症，自身免疫性疾病，抗休克治疗，血液病，皮炎等（C错）。异丙肾上腺素静脉用于完全性房室传导阻滞、心脏骤停（D错）。阿托品用于缓解内脏绞痛，如胃肠痉挛引起的疼痛、肾绞痛、胆绞痛（E错）。